流行性出血热发热早期抗病毒治疗为
A. 扩充血容量
B. 激素应用
C. 利巴韦林治疗
D. 肝素抗凝治疗
E. 血液透析

正确答案：C。利巴韦林治疗